高度脾肿大可见于
A. 结缔组织病
B. 急性白血病
C. 慢性溶血性贫血
D. 慢性粒细胞白血病
E. 骨髓增生异常综合征

正确答案：D。慢性粒细胞白血病

解析：脾脏高度肿大见于慢性粒细胞白血病（D对）。慢性溶血性黄疸（C错）（溶血性贫血可导致溶血性黄疸）可导致脾脏中度肿大。结缔组织病（A错）、急性白血病（B错）、骨髓增生异常综合征（E错）可伴有脾肿大，但不会出现脾高度肿大。